属于β受体阻滞剂的降压药是
A. 卡托普利
B. 硝苯地平
C. 维拉帕米
D. 阿替洛尔
E. 哌唑嗪

正确答案：D。阿替洛尔

解析：阿替洛尔（D对）属于β受体阻滞剂。卡托普利（A错）属于血管紧张素转换酶抑制剂。硝苯地平（B错）和维拉帕米（C错）均属于钙通道阻滞剂。哌唑嗪（九版药理学P87）（E错）属于选择性α₁受体阻断剂。